可产生酶促作用，加快胆红素排泄，使新生儿黄疸消退的药品是
A. 维生素K
B. 苯巴比妥
C. 毛花苷丙
D. 苯妥英钠
E. 普萘洛尔

正确答案：B。苯巴比妥